心迷走神经末梢释放的递质作用于心肌细胞膜上的受体是
A. N受体
B. M受体
C. α受体
D. β₁受体
E. β₂受体

正确答案：B。M受体